属于但热不寒的症状有
A. 定时潮热
B. 恶寒发热
C. 高热不退
D. 骨蒸潮热
E. 寒热往来

正确答案：A、C、D。定时潮热；高热不退；骨蒸潮热